卡托普利降压作用不包括
A. 抑制血管紧张素Ⅰ转化酶
B. 抑制体内去甲肾上腺素释放
C. 减少缓激肽的降解
D. 不改变血容量
E. 抑制体内肾上腺素释放

正确答案：D。不改变血容量

解析：卡托普利属于血管紧张素转化酶抑制药，可以通过抑制血管紧张素I转化酶（A对），阻止AngⅡ的生成，减弱AngⅡ收缩血管、刺激醛固酮释放等效应，从而减少血容量，产生降压作用（D错，为本题正确答案）；此外，可以抑制体内去甲肾上腺素（B对）和肾上腺素的释放（E对），从而减弱交感神经过度兴奋所出现的血管收缩等效应，产生降压作用；还可减少缓激肽的降解（C对），进一步发挥缓激肽以及缓激肽受体激活产物NO和PGI2的舒血管作用，产生降压作用。